煤焦油可致皮肤癌。研究发现，经煤焦油涂抹的皮肤如再接触佛波酯，肿瘤的发生率增高，潜伏期缩短。据此实验，佛波酯应属
A. 无机致癌物
B. 免疫抑制剂
C. 促长剂
D. 助致癌物
E. 细胞毒剂

正确答案：C。促长剂